女，2岁。自幼牛乳喂养，未按要求添加辅食，有时腹泻，逐渐消瘦。体检：身高80cm，体重7000g，皮下脂肪减少，腹壁皮下脂肪厚度＜0.4cm，皮肤干燥苍白，肌张力明显减低，肌肉松弛，脉搏缓慢，心音较低钝。此患儿目前最可能的主要诊断应是
A. 营养性缺铁性贫血
B. 先天性甲状腺功能减低症
C. 营养不良
D. 婴幼儿腹泻
E. 心功能不全

正确答案：C。营养不良

解析：正常2岁儿童体重=年龄×2+8=2×2+8=12kg，而该患儿体重只有体重7000g，呈体重下降，并且有皮下脂肪减少、肌张力明显减低的表现，应诊断为营养不良（C对）。虽然营养不良可以并发营养性缺铁性贫血，但是该患儿并没有营养性缺铁性贫血的表现，所有并不能诊断为营养性缺铁性贫血（A错）。该患儿仅仅是有生长发育方面的症状，并没有智力方面的问题，不能诊断为先天性甲状腺功能减低症（B错）。婴幼儿腹泻属于生理性腹泻，生理性腹泻除腹泻外没有其它症状，更不会引起体重下降（D错）。仅凭心音较低钝并不可以诊断为心功能不全，心功能不全会有特殊的心脏杂音以及发绀等临床症状（E错）。